患者，女，26岁，已婚。胃脘痞满，不思饮食，频频泛恶，干呕，大便秘结，舌红少津，脉细弱。其病机是
A. 脾阴不足
B. 胃阴不足
C. 胃燥津亏
D. 胃热炽盛
E. 肝胃不和

正确答案：B。胃阴不足

解析：胃阴虚证是胃阴亏虚所表现的证候。胃脘痞满多因胃阴不足，虚热内生，热郁胃中，胃气失和所致；不思饮食多因阴亏而胃失濡润，纳化失常所致；频频泛恶，干呕，均多因胃失和降，胃气上逆所致；大便秘结多因胃阴亏虚，不能下润所致；舌红少津，脉细弱，均多因阴液亏少所致。故病机为胃阴不足（B对）。脾阴不足，为人造干扰项（A错）。胃燥津亏的辨证要点以胃阴虚证，虚热证不明显共见为主要表现（C错）。胃热炽盛的辨证要点以胃脘灼痛、消谷善饥等与实火症状共见为主要表现，非上述症状（D错）。肝胃不和的辨证要点以胃脘、胁肋胀痛或窜痛，嗳气吞酸等为主要表现，非上述症状（E错）。